男性，40岁。陈旧性心肌梗死3年，高血压病史4年，体检：BP150/95mmHg，心率90次/分，降压治疗宜首选
A. α受体阻滞剂
B. β受体阻滞剂
C. 利尿剂
D. 二氢吡啶类钙通道阻滞剂
E. 神经节阻断剂

正确答案：B。β受体阻滞剂

解析：患者中年男性，有心肌梗死和高血压病史，BP150/95mmHg（正常值90～139/60～89mmHg，提示轻度高血压），心率稍快（90次/分），降压治疗宜首选β受体阻滞剂（B对）。β受体阻滞剂可抑制中枢和周围RAAS，抑制心肌收缩力和减慢心率发挥降压作用，而且其还是目前冠心病二级预防的常用药物，特别适合于心率快且伴心肌梗死病史的中青年高血压患者。用于抗高血压治疗的α受体阻滞剂（A错）主要为α₁受体阻滞剂，如哌唑嗪、特拉唑嗪等，因其副作用较多，目前不主张单独使用（P255）。利尿剂（P253）（C错）降压作用主要通过排钠，减少细胞外容量，降低外周血管阻力。适用于单纯收缩期高血压、盐敏感性高血压、合并肥胖或糖尿病、合并心力衰竭的患者。二氢吡啶类钙通道阻滞剂（D错）可引起反射性交感活性增强，导致心率增快、头痛等不良反应。神经节阻断剂（九版药理学P225）（E错）可使小动脉扩张，总外周阻力下降，加上静脉扩张，回心血量和心输出量减少，使血压显著下降。但由于其副作用多，降压作用过强过快，现仅限用于一些特殊情况，如高血压危象、主动脉夹层动脉瘤、外科手术中的控制性低血压等。